出现面瘫，舌前2/3味觉减退，唾液腺分泌障碍，听觉障碍。面神经的损伤部位位于
A. 膝状神经节
B. 鼓索与镫骨肌神经节之间
C. 脑桥与膝状神经节之间
D. 镫骨肌与膝状神经节
E. 茎乳孔以外

正确答案：D。镫骨肌与膝状神经节

解析：根据味觉、听觉及泪液检查结果，还可明确面神经损害部位，从而作出相应的损害定位诊断。镫骨肌与膝状神经节之间：面瘫+味觉丧失+唾液腺分泌障碍+听觉改变。掌握“面神经麻痹”知识点。